下列有关淋病的描述哪项是错误的
A. 女性较男性易传染
B. 主要通过性交传染
C. 为一种急性或慢性传染病
D. 女性感染后约60％可无症状
E. 诊断主要依赖于活体组织检查

正确答案：E。诊断主要依赖于活体组织检查

解析：本题考查淋病。细菌培养是目前确诊淋病的唯一推荐方法（E错，为本题的正确答案），可出现典型菌落，氧化酶试验阳性，镜检可见到革兰阴性双球菌，必要时可做糖发酵及荧光抗体检查加以确诊。淋病是由淋病奈瑟菌所致的泌尿生殖系统感染，其潜伏期短，传染性强，为一种急性或慢性传染病（C对），主要通过性接触传播（B对），女性较男性易传染（A对），女性感染后约60％可无症状（D对）。